肺癌常见的症状是
A. 脓性痰
B. 白色泡沫样痰
C. 刺激性咳嗽和血痰
D. 胸闷、干咳
E. 肺部干啰音

正确答案：C。刺激性咳嗽和血痰

解析：肺癌常见的症状是刺激性咳嗽和血痰。刺激性咳嗽是癌肿在较大的支气管内生长引起，血痰为痰中带点血丝或断续少量咯血。掌握“肺癌”知识点。